有关阿莫西林说法正确的是
A. 用于消化性溃疡
B. 用于敏感菌所致的呼吸道治疗
C. 抗菌谱和抗菌活性与氨苄西林相似
D. 对幽门螺杆菌的杀菌作用比氨苄西林强
E. 以上说法均正确

正确答案：E。以上说法均正确

解析：阿莫西林的抗菌作用及临床应用：抗菌谱和抗菌活性与氨苄西林相似，但对肺炎球菌、肠球菌、沙门菌属、幽门螺杆菌的杀菌作用比氨苄西林强。主要用于敏感菌所致的呼吸道、尿路、胆道感染以及伤寒治疗。此外，也可用于慢性活动性胃炎和消化性溃疡的治疗。掌握“青霉素及头孢菌素类药”知识点。